有关免疫球蛋白和抗体的说法，正确的是
A. 免疫球蛋白就是抗体、二者具有相同的含义
B. 免疫球蛋白均为抗体，抗体不一定都是免疫球蛋白
C. 免疫球蛋白与抗体不同，二者也不相关
D. 抗体均为免疫球蛋白，而免疫球蛋白并不一定都是抗体
E. 抗体和免疫球蛋白只存在于血液和体液中，二者均具有免疫功能

正确答案：D。抗体均为免疫球蛋白，而免疫球蛋白并不一定都是抗体